女性，40岁。左乳房外上象限4cm×3cm肿块，距乳头距离5cm，可推动，但是病人双手叉腰时肿块活动度明显受限，左腋窝未扪及肿大淋巴结。术后选择CMF方案辅助化疗，应使用的周期数是
A. 2
B. 6
C. 10
D. 14
E. 18

正确答案：B。6

解析：乳腺癌是实体瘤中应用化疗最有效的肿瘤之一，化疗在整个治疗中占有重要地位。常用的化疗方案包括CAF方案（环磷酰胺、多柔比星、氟尿嘧啶）和CMF方案（环磷酰胺、甲氨蝶呤、氟尿嘧啶）两种。CMF方案共6（B对）个疗程，每4周一个疗程。CAF方案共8个疗程，每4周一个疗程。